巩膜静脉窦位于巩膜与()的交界处
A. 结膜
B. 角膜
C. 虹膜
D. 睫状体
E. 眼静脉

正确答案：B。角膜

解析：巩膜静脉窦位于巩膜与角膜（B对）的交界处。